某片剂的有效期为2年，根据《药品说明书和标签管理规定》，生产日期为2011年10月31日的产品，有效期可标注为
A. 有效期至10月/2013年
B. 有效期至2013年11月
C. 有效期至2013年10月31号
D. 有效期至2013年11月01号
E. 有效期至2013年10月30号

正确答案：E。有效期至2013年10月30号

解析：本题考查药品标签上药品有效期的规定。某片剂的有效期为2年，根据《药品说明书和标签管理规定》，生产日期为2011年10月31日的产品，有效期可标注为有效期至2013年10月30号（E对）。药品标签上药品有效期的规定：药品标签中的有效期应当按照年、月、日的顺序标注，年份用四位数字表示，月、日各用两位数表示。其具体标注格式为“有效期至××××年××月”或者“有效期至××××年××月××日”；也可以用数字和其他符号表示为“有效期至××××.××.”或者“有效期至××××/××/××”等。预防用生物制品有效期的标注按照国家药品监督管理部门批准的注册标准执行，治疗用生物制品有效期的标注应自分装日期计算，其他药品有效期的标注以生产日期计算。有效期若标注到日，应当为起算日期对应年月日的前一天；若标注到月，应当为起算月份对应年月的前一月。如果由于包装尺寸或者技术设备等原因有效期确难以标注为“有效期至某年某月”的，可以标注有效期实际期限，如“有效期24个月。